属于钙通道阻滞剂的抗心律失常药是
A. 利多卡因
B. 普鲁卡因胺
C. 胺碘酮
D. 维拉帕米
E. 去乙酰毛花苷

正确答案：D。维拉帕米

解析：本题考查抗心律失常药的分类。维拉帕米（D对）为钙通道阻滞剂，主要用于心绞痛，室上性心律失常，原发性高血压。利多卡因（A错）属于Ⅰb类抗心律失常药，仅用于室性心律失常。普鲁卡因胺（B错）为Ⅰa类抗心律失常药，属广谱抗心律失常药，用于危及生命的室性心律失常。胺碘酮（C错）为延长动作电位时程的药，用于治疗室上性和室性心律失常。去乙酰毛化苷（E错）为强心苷类正性肌药，用于急性心力衰竭、慢性心率衰竭急性加重等。